关于重症肌无力下述哪项是错误的
A. 临床特征为部分或全身骨骼肌疲劳
B. 症状常晨轻暮重，重复活动后加重、休息后减轻
C. 是一种获得性自身免疫性疾病
D. 抗胆碱酯酶药物治疗有效
E. 腾喜龙试验阴性

正确答案：E。腾喜龙试验阴性

解析：关于重症肌无力错误的是腾喜龙试验是阴性的（E错，为本题正确答案），腾喜龙试验阳性是重症肌无力的诊断性试验之一。重症肌无力是一种神经-肌肉接头传递功能障碍的获得性自身免疫性疾病（C对），临床主要表现为部分或全身骨骼肌无力和极易疲劳（A对），肌无力症状常晨轻暮重，重复活动后加重、休息后减轻（B对），抗胆碱酯酶药物治疗有效（D对）。